下列关于吗啡的抑制呼吸作用叙述错误的是
A. 不可抑制呼吸
B. 可使呼吸频率减慢、潮气量降低
C. 呼吸抑制是吗啡急性中毒致死的主要原因
D. 呼吸抑制发生的快慢及程度与给药途径密切相关
E. 随剂量增加而作用增强

正确答案：A。不可抑制呼吸

解析：吗啡抑制呼吸：治疗量即可抑制呼吸，使呼吸频率减慢、潮气量降低、每分通气量减少，其中呼吸频率减慢尤为突出，并随剂量增加而作用增强，呼吸抑制是吗啡急性中毒致死的主要原因。呼吸抑制发生的快慢及程度与给药途径密切相关。该作用与其降低脑干呼吸中枢对血液CO2张力的敏感性，以及抑制脑桥呼吸调节中枢有关。掌握“吗啡、哌替啶”知识点。